根据《中华人民共和国反不正当竞争法》，下列不正当竞争行为的定性，不属于限制竞争行业的是
A. 具有独占地位的经营者，指定他人购买本企业的商品
B. 政府及其所属部门不准外地商品进入本市场
C. 在药品招标中，投标者互相串通，故意抬高标价
D. 个体经营者以利诱的方式，获取权利人的商业秘密

正确答案：D。个体经营者以利诱的方式，获取权利人的商业秘密

解析：本题考查限制竞争行为。限制竞争行为包括：①公用企业或者其他依法具有独占地位的经营者，不得限定他人购买其指定的经营者的商品，以排挤其他经营者的公平竞争。②政府及其所属部门不得滥用行政权力，限定他人购买其指定的经营者的商品，限制其他经营者正当的经营活动:限制外地商品进入本地市场，或者本地商品流向外地市场。故B属于限制竞争行为。③经营者销售商品，违背购买者的意愿搭售商品或者附加其他不合理的条件。④投标者串通投标，抬高标价或者压低标价;投标者和招标者相互勾结，以排挤竞争对手的公平竞争。